以上哪项检查可以用于筛查丙肝
A. HCVRNA
B. HCV抗体
C. HCV抗原
D. HBeAg
E. HBeAb

正确答案：B。HCV抗体

解析：HCV抗体是HCV感染标志，用于筛查丙肝（B对）。